男，55岁。上腹疼痛8小时。进食高脂餐并饮酒后出现上腹痛，呕吐2次后疼痛无缓解。查体：T37.8℃，巩膜轻度黄染，心肺未见异常，上腹偏左压痛、反跳痛阳性。最有意义的辅助检查是
A. 心电图
B. 血常规
C. 血清脂肪酶
D. 血清淀粉酶
E. 立位腹部X线平片

正确答案：D。血清淀粉酶

解析：中年男性患者，进食高脂餐并饮酒后上腹持续疼痛8小时、呕吐2次后疼痛无缓解（饮酒、进食高脂餐是急性胰腺炎的常见诱因，急性腹痛、吐后疼痛不缓解为急性胰腺炎的典型症状）。查体：T37.8℃，上腹偏左压痛、反跳痛阳性（腹膜刺激征为急性胰腺炎的常见体征）。综合患者的病史、临床表现，可初步诊断为急性胰腺炎。血清淀粉酶，常在急性胰腺炎发病后2～12小时开始升高，48小时开始下降，持续3～5天。该患者发病仅8小时，血清淀粉酶（D对）为其最有诊断意义的辅助检查。血清脂肪酶（C错）一般在发病后24～72小时开始升高。心电图（A错）主要用于心肌梗死、心律失常等的诊断。血常规（B错）为一般性检查，不具特异性。立位腹部X线平片（E错）常用于消化道穿孔、肠梗阻等的诊断。